三黄片的功能是
A. 泻火通便，清肝明目
B. 清热解毒，利水消肿
C. 清热通便，散风止痛
D. 清热解毒，泻火通便
E. 清热燥湿，泻火解毒

正确答案：D。清热解毒，泻火通便